能治疗新生儿黄疸的药物是
A. 氯霉素
B. 新生霉素
C. 磺胺嘧啶
D. 葡萄糖
E. 苯巴比妥

正确答案：E。苯巴比妥